尘肺X线诊断标准中“t”小阴影是指
A. 直径在1.5mm以下的类圆形小阴影
B. 直径在1.5～3mm的类圆形小阴影
C. 直径在3～10mm的类圆形小阴影
D. 宽度在1.5mm以下的不规则形小阴影
E. 宽度在1.5～3mm的不规则形小阴影

正确答案：E。宽度在1.5～3mm的不规则形小阴影